下列哪项不是急性龋的特点
A. 多见于儿童及青年人
B. 病变组织颜色浅
C. 病变进展快
D. 质地软而湿
E. 去腐时必须用钻去除

正确答案：E。去腐时必须用钻去除

解析：本题考查急性龋的特点。去腐时必须用钻去除（E错，为本题的正确答案）不是急性龋的特点。急性龋多见于儿童及青年人（A对），病变组织颜色较浅（B对），病程进展快（C对），质地较软且湿润（D对），临床上很容易用挖器剔除，去腐时可不用钻去除。